症状主要表现在
A. 左侧
B. 右侧
C. 两侧均有
D. 左轻右重
E. 以上都不对

正确答案：A。左侧

解析：小脑的传出纤维在传导过程中有两次交叉，对躯体活动发挥的同侧协调作用。因而左侧小脑半球病变，症状主要表现在左侧（A对）。